产后出血的治疗原则是
A. 加强宫缩是最迅速有效的止血方法
B. 及时准确地修补、缝合裂伤可有效地止血
C. 切除子宫
D. 行人工徒手剥离胎盘
E. 针对原因迅速止血、补充血容量纠正休克及防治感染

正确答案：E。针对原因迅速止血、补充血容量纠正休克及防治感染